属于高温、高湿型作业的是
A. 炼钢
B. 地质勘探
C. 印染
D. 铸造
E. 熔玻璃

正确答案：C。印染